表面活性剂包括
A. 环氧乙烷
B. 甲醛
C. 高锰酸钾
D. 新洁尔灭
E. 醋酸苯汞

正确答案：D。新洁尔灭

解析：本题考查表面活性剂。苯扎溴铵（商品名为新洁尔灭（D对））是阳离子表面活性剂。表面活性剂包括阳离子表面活性剂、阴离子表面活性剂、两性离子表面活性剂和非离子表面活性剂。环氧乙烷（A错）为烷基化合物；甲醛（B错）为醛类消毒剂；高锰酸钾（C错）为氧化剂；醋酸苯汞（E错）可作为外科局部消毒剂。